首选治疗立克次体感染的药物是
A. 林可霉素
B. 红霉素
C. 青霉素
D. 链霉素
E. 四环素

正确答案：E。四环素

解析：四环素类药物首选治疗立克次体感染、支原体感染、衣原体感染及某些螺旋体感染。掌握“红霉素及林可霉素”知识点。